患者于睡眠中突然憋醒，有窒息感，被迫坐起，约10分钟后症状缓解，最可能的诊断是
A. 支气管哮喘发作
B. 右心衰竭
C. 左心衰竭
D. 肺气肿
E. 自发性气胸

正确答案：C。左心衰竭

解析：左心衰竭（C对）时肺循环淤血以及心排出量降低导致夜间阵发性呼吸困难，患者可表现为于睡眠中突然憋醒，有窒息感，被迫坐起，符合题意。支气管哮喘发作（A错）症状可在数分钟内发生，并持续数小时至数天，可经平喘药物治疗后缓解或自行缓解，夜间和凌晨发作或加重是哮喘的重要临床特征，但不会因体位变换而缓解。右心衰竭（B错）以体循环淤血为主要表现，常见症状为胃肠道及肝淤血引起的腹胀、食欲不振、恶心、呕吐等，与体位无关。肺气肿（D错）早期可无症状或仅在劳动、运动时感到气短。随着肺气肿进展，呼吸困难程度随之加重，以至稍活动甚或完全休息时仍感气短，与体位无关。自发性气胸（E错）大多数起病急骤，患者突感一侧胸痛，针刺样或刀割样，持续时间短暂，继之胸闷和呼吸困难，可伴有刺激性咳嗽，如果病因不解除，症状会持续存在。